下列哪一项有关青春期的论述是不正确的
A. 无论男女，出现生长突增都表明青春期发育已经开始
B. 男女孩都在青春早期达到生长突增高峰
C. 男女孩都在青春中期出现第二性征的迅速发育
D. 女孩出现月经初潮、男孩出现首次遗精后身高增长速度减缓
E. 女孩青春期发育通常快于男孩

正确答案：E。女孩青春期发育通常快于男孩